吸入气雾剂的给药部位是
A. 肝脏
B. 肾脏
C. 肺
D. 胆
E. 心脏

正确答案：C。肺

解析：本题考查气雾剂。吸入气雾剂使用时将内容物呈雾状喷出并吸入肺部，给药部位是肺（C对）。